患者，男性，68岁。反复咳嗽、咳痰、咯血40余年，再发咯血10天入院，查体：体温37.8℃，消瘦，双肺叩呈过清音，呼吸音减弱，右上肺可闻及湿啰音。胸部CT见右肺门上提、肺门呈垂柳状、上肺厚壁空洞，该患者首先考虑的是
A. 原发型肺结核
B. 浸润型肺结核
C. 血行播散型肺结核
D. 结核性渗出性胸膜炎
E. 慢性纤维空洞型肺结核

正确答案：E。慢性纤维空洞型肺结核